《全日制中小学校工作条例》规定，中学生寒暑假应有
A. 半个月
B. 1个月
C. 1个半月
D. 2个月
E. 2个半月

正确答案：D。2个月